嘌呤碱在体内分解的终产物是
A. 次黄嘌呤
B. 黄嘌呤
C. 别嘌呤醇
D. 氨、CO₂和有机酸
E. 尿酸

正确答案：E。尿酸